HDV复制中，需要HBV为其提供的主要物质是
A. 复制酶
B. 整合酶
C. 逆转录酶
D. 包膜
E. 核蛋白

正确答案：D。包膜

解析：病毒复制必须有HBV或其他嗜肝DNA病毒辅助获得包膜，才能复制增值。掌握“丙型、丁型、戊型肝炎病毒”知识点。